关于吸入气雾剂吸收与作用特点的说法，错误的是
A. 具有速效和定位作用
B. 肺泡是其药物的主要吸收部位
C. 药物的吸收作用与其脂溶性成正比
D. 药物的吸收作用与其分子大小成反比
E. 药物的吸收作用与其雾滴粒径大小成反比

正确答案：E。药物的吸收作用与其雾滴粒径大小成反比

解析：本题考查的是气雾剂吸收与作用特点。雾滴（粒）粒径大小，雾滴（粒）的大小影响其在呼吸道沉积的部位（E错，为本题正确答案）。气雾剂的特点：（1）具有速效和定位作用（A对）。（2）制剂稳定性高。（3）给药剂量准确。（4）局部用药的刺激性小。吸入气雾剂与喷雾剂的吸收与影响因素：吸入气雾剂和吸入喷雾剂给药时，药物以雾状吸入可直接作用于支气管平滑肌，适宜粒径的雾滴在肺泡部位有较好的分布和沉积，肺泡为药物的主要吸收部位（B对）。影响吸入气雾剂和吸入喷雾剂药物吸收的主要因素有：①药物的脂溶性及分子大小，吸入给药的吸收速度与药物的脂溶性成正比（C对），与药物的分子大小成反比（D对）。②雾滴（粒）粒径大小，雾滴（粒）的大小影响其在呼吸道沉积的部位，吸入气雾剂雾滴（粒）的粒径应在10μm以下，其中大多数应在5μm以下。雾滴过粗，药物易沉着在口腔、咽部及呼吸器官的各部位；粒子过小，雾滴（粒）易到达肺泡部位，但沉积减少，多被呼出，吸收较少。